ADH主要由何处合成
A. 腺垂体
B. 神经垂体
C. 下丘脑视上核
D. 下丘脑室旁核
E. 肾脏

正确答案：C。下丘脑视上核